谷芽的功效是
A. 消食和中，健脾开胃
B. 消食运脾，固精止遗
C. 消食和中，行气化湿
D. 消食健脾，行气导滞
E. 消食除胀，化痰下气

正确答案：A。消食和中，健脾开胃

解析：本题考查的是谷芽的功效。谷芽的功效是消食和中，健脾开胃（A对）。谷芽功效与稻芽相似。稻芽：【功效】消食和中，健脾开胃。既往有些地区习惯将稻芽称为谷芽。今将谷芽定为禾本科植物粟的成熟果实经发芽干燥的炮制加工品。其味甘性微温，功效与稻芽相似，食积兼寒者用之为宜。鸡内金：【功效】运脾消食，固精止遗（B错），化坚消石。木香：【功效】行气止痛，健脾消食（D错）。莱菔子：【功效】消食除胀，降气化痰（E错）。功效为消食和中，行气化湿（C错）的中药，2022年考试指南未明确说明。